男性，56岁。劳累后心前区闷痛史6年，近1周来常因夜间胸痛而惊醒，发作时心电图特征为：ST段Ⅱ、Ⅲ、avF导联上抬0.2mV，胸痛缓解后上抬消失，疼痛发作时最不宜单用下列哪种药物
A. β受体阻断剂
B. 硝苯地平
C. 硝酸甘油
D. 硝酸异山梨酯
E. 丹参制剂

正确答案：A。β受体阻断剂